质谱（MS）在分子结构测定中的应用是
A. 测定分子量
B. 确定官能团
C. 推算分子式
D. 根据裂解峰推测结构式
E. 判断是否存在共轭体系

正确答案：A、C、D。测定分子量；推算分子式；根据裂解峰推测结构式

解析：本题考查的是质谱的作用的掌握。测定分子量（A对）、推算分子式（C对）与根据裂解峰推测结构式（D对）。质谱（MS）可用于确定分子量及求算分子式和提供其他结构信息。红外光谱（IR）可用于鉴别许多特征官能团（B错），如胫基、氨基以及重键、芳环等；可进行化合物的真伪比较鉴别。紫外-可见光吸收光谱（UV）：UV 光谱对于分子中含有共轭双键（E错）、a， β－不饱和羰基（醛、酮、酸、酯）结构的化合物以及芳香化合物的结构鉴定来说是一种重要的手段。通常主要用于推断化合物的骨架类；某些情况下，如香豆素类、黄酮类等化合物，它们的UV光谱在加入某种诊断试剂后可因分子结构中取代基的类型、数目及排列方式不同而改变，故还可用于测定化合物的精细结构。